钩端螺旋体病确诊后，首选下列哪种抗生素
A. 青霉素G
B. 四环素
C. 氯霉素
D. 庆大霉素
E. 头孢菌素

正确答案：A。青霉素G

解析：钩端螺旋体能引起人及动物的钩端螺旋体病，是一种广泛流行的人畜共患病。对钩端螺旋体引起的感染首选药物青霉素（A对）。四环素（B错）（P391）属于四环素类抗生素，由于耐药菌株日益增多和药物的不良反应，现一般不用做首选药。氯霉素（C错）（P393）对造血系统可产生致命的毒性，需要严格掌握适应征，如无法使用青霉素类的脑膜炎、多药耐药的流感嗜血杆菌感染等，，且病情严重已威胁生命。庆大霉素（D错）（P388）属于氨基糖苷类抗生素，是治疗各种革兰染色阴性杆菌的主要抗菌药。头孢菌素（E错）（P373）属于β-内酰胺类抗生素，主要用于革兰阳性菌及革兰阴性菌的治疗。